属于保健食品特征的是
A. 属于食品
B. 可以代替正常膳食
C. 可用于治疗疾病
D. 适用于所有人群
E. 在用量上无要求

正确答案：A。属于食品

解析：本题考查保健食品的特征。保健食品应该具有以下特征：1.保健食品属于食品（A对）：保健食品是食品的一个种类，具有食品的共性。但在食用量上有限制（E错），不能替代正常膳食（B错）；2.保健食品不是药物：保健食品是以调节机体功能为主要目的，不能用于治疗疾病（C错），对人体不产生任何急性、亚急性或慢性危害，可以长期服用；3.保健食品具有特定的保健功能：如增强免疫力、抗氧化、减肥、促进生长发育、缓解体力疲劳等功能；4.保健食品适于特定人群食用（D错）：保健食品是针对亚健康人群设计的，不同功能的保健食品对应的是不同特征的亚健康人群，如减肥的保健食品只适用于肥胖人群，辅助降血糖/降血脂的保健食品只适用于血糖/血脂偏高的人群食用等。